苦味的作用是
A. 能散
B. 能涩
C. 能坚
D. 能软
E. 能和

正确答案：C。能坚

解析：本题考查的是五味对人体的效果。苦味的作用是能坚（C对）。五味对人体的效果：（1）辛：能散（A错）、能行，有发散、行气、活血作用。（2）甘：能补、能缓、能和（E错），有补虚、和中、缓急、调和药性等作用。（3）酸：能收、能涩（B错），有收敛固涩作用。（4）苦：能泄、能燥、能坚。（5）咸：能软（D错）、能下，有软坚散结、泻下通便作用。（6）涩：能收、能敛，同酸味一样有收敛固涩作用。（7）淡：能渗、能利，有渗湿利水作用。此外，还有芳香味，其能散、能行、能开，有化湿、辟秽、开窍、醒脾等作用。